可能影响儿童骨骼发育的药物是
A. 复方磺胺甲噁唑
B. 头孢克洛
C. 诺氟沙星
D. 阿莫西林
E. 华法林

正确答案：C。诺氟沙星

解析：本题考查特殊人群用药。可能影响儿童骨骼发育的药物是诺氟沙星（C对）。儿童期运动系统发育较为稚嫩，骨骼肌相对柔弱，骺软骨处于不断增生和不断骨化的过程中。某些药物如喹诺酮类抗菌药物可引起关节痛、关节肿胀及软骨损害，影响骨骼发育。磺胺甲噁唑（A错）在乳汁中的浓度与血浆中一致，在体内与胆红素竞争血浆蛋白，可致游离胆红素增高，尤其在新生儿黄疸时，可促使发生新生儿胆红素脑病（核黄疸）。头孢菌素类（B错）在乳汁中含量甚微，但第四代头孢菌素类如头孢匹罗、头孢吡肟例外。青霉素类（D错）对乳儿安全。